首过效应主要发生于下列哪种给药方式
A. 静脉给药
B. 口服给药
C. 舌下含化
D. 肌肉注射
E. 透皮吸收

正确答案：B。口服给药

解析：本题考查首过消除。由首过效应的定义可知，药物进入体循环前的降解或失活称为“首过代谢”或“首过效应”，口服给药（B对）时，药物经胃肠道吸收、肝脏代谢。静脉给药（A错）直接将药物送入血液循环；舌下含化（C错）通过舌下静脉吸收入血进入血液循环；肌肉注射（D错）经肌肉中的毛细血管吸收入血进入血液循环；透皮吸收（E错）是药物经过皮肤毛细血管吸收，以上四种均不会产生首过效应。